灭活病毒无效的因素是
A. 干扰素
B. 乙醚
C. 青霉素
D. ﹣70℃
E. 紫外线

正确答案：C。青霉素